急性坏死性胰腺炎的腹痛特点是
A. 一侧腹痛，持续性，向会阴部放射
B. 上腹持续性剧烈腹痛，成束带状，向腰背部放射
C. 上腹钻顶样剧烈腹痛，阵发性加剧，间歇期完全缓解
D. 上腹剧烈样绞痛，阵发性，向右侧肩部放射
E. 上腹突发刀割样剧烈腹痛，迅速波及全腹

正确答案：B。上腹持续性剧烈腹痛，成束带状，向腰背部放射

解析：急性胰腺炎腹痛的临床表现：常于饱餐和饮酒后突然发作，腹痛剧烈，多位于左上腹，向左肩及左腰背部放射。病变累积全胰时，疼痛范围较宽呈束带状向腰背部放射（B对）。急性坏死型胰腺炎，表现为上腹持续剧烈腹痛，向左上腹，左肩及左侧腰背部放射，累及全胰腺时，成束带状向腰背部放射。上腹突发刀割样剧烈腹疼，为消化道穿孔。